某男，42岁。5年前诊断为糖尿病，经中西药治疗，病情得以控制。近日血糖有所升高，遂求中医诊治。刻下多食善饥，每日需进食十余餐，餐后2小时左右便出现饥饿感，伴口渴多饮、乏力、小便频数而多、口苦咽干、舌质红、苔黄燥、脉细数。医生诊断为消渴病，证属阴虚火旺、津液被伤。处方：生石膏（先煎）30g，熟地黄10g，麦冬10g，知母10g，牛膝10g，柴胡5g，葛根10g，生甘草3g。方中生石膏与知母配伍属于
A. 相使
B. 相畏
C. 相杀
D. 相须
E. 相恶

正确答案：D。相须

解析：本题考查的是七情配伍。生石膏与知母配伍属于相须（D对）。“七情配伍”，又称配伍七情、药物七情。即指单味中药配伍同用的七种情形。除“单行”外，皆从双元配伍用药角度，论述单味中药通过简单配伍后的性效变化规律。（1）单行：即应用单味药就能发挥预期治疗效果，不需其他药的辅助。如独参汤，单用人参一味补气固脱等。（2）相须：即性能相类似的药物合用，可增强原有疗效。如石膏配知母可增强清热泻火效果等。（3）相使（A错）：即性能功效有某种共性的两药同用，一药为主，一药为辅，辅药能增强主药的疗效。如以补气利水的黄芪为主，配以利水健脾的茯苓为辅，茯苓能增强黄芪的补气利水效果等。（4）相畏（B错）：即一种药物的毒烈之性，能被另一种药物减轻或消除。如生半夏的毒性能被生姜减轻或消除，故云半夏畏生姜。（5）相杀（C错）：即一种药物能减轻或消除另一种药物的毒烈之性。如生姜能减轻或消除生半夏的毒性，故习云生姜杀半夏。（6）相恶（E错）：即两药合用，一种药物能使另一种药物原有功效降低，甚至丧失。如人参恶莱菔子，因莱菔子能削弱人参的补气作用。（7）相反：即两种药物合用，能产生或增强毒害反应。如乌头反半夏、甘草反甘遂等。